男，37岁。在心脏手术过程中，病人心电图表明：突然发生Ⅲ度房室传导阻滞。此时该用何药作紧急处置
A. 静注阿托品
B. 静滴异丙肾上腺素
C. 静注肾上腺素
D. 静滴山莨菪碱
E. 静滴去甲上肾腺素

正确答案：B。静滴异丙肾上腺素

解析：异丙肾上腺素可用于治疗房室传导阻滞，舌下含药或静脉滴注给药，治疗Ⅱ、Ⅲ度房室传导阻滞。掌握“多巴胺和异丙肾上腺素”知识点。